抗精神失常药是指
A. 治疗精神活动障碍的药物
B. 治疗精神分裂症的药物
C. 治疗焦虑症的药物
D. 治疗躁狂症的药物
E. 治疗抑郁症的药物

正确答案：A。治疗精神活动障碍的药物

解析：精神失常是由多种原因引起的精神活动障碍的一类疾病，包括精神分裂症、躁狂症、忧郁症和焦虑症。掌握“丙米嗪、碳酸锂、氟西汀”知识点。